既可内服又外用的剂型是
A. 钉剂
B. 锭剂
C. 条剂
D. 棒剂
E. 丹剂

正确答案：B。锭剂

解析：本题考查的是其他传统制剂。既可内服又外用的剂型是锭剂（B对）。锭剂系指饮片细粉加适宜黏合剂（或利用饮片细粉本身的黏性）制成不同形状的固体制剂。有长方形、纺锤形、圆柱形、圆锥形等。供内服，可吞服或研细以水或黄酒化服，外用多是研细用醋或酒调敷，也可作嗅入或外搽药用。钉剂（A错）：系指饮片细粉加糯米混匀后加水加热制成软材，分剂量，搓成细长而两端尖锐（或锥形）的外用固体制剂。钉剂多含有毒性药物或腐蚀性药物，其赋形剂的选择类似于糊丸，具缓释作用。一般供外科插入，用于治疗痔、瘘管及溃疡等。条剂（C错）：系指用桑皮纸粘药膏后搓捻成细条，或用桑皮纸搓捻成条，粘一层面糊，再粘药粉而制成的外用制剂，又称纸捻。条剂有韧性可用于弯曲分岔的瘘管，制备简单，使用方便。所用药物多有毒性或腐蚀性，主要用于中医外科插入疮口或瘘管，以引流脓液，拔毒去腐，生肌敛口。棒剂（D错）：系指将药物制成小棒状的外用制剂。可直接用于皮肤或黏膜，起腐蚀、收敛等作用，多用于眼科。丹剂（E错）：系指汞以及某些矿物药，在高温条件下烧炼制成的不同结晶形状的汞的无机化合物。丹剂毒性较大，不可内服，仅供外用。可制成散剂、钉剂、药线、药条和外用膏剂。使用时要注意剂量和部位，以免引起中毒。丹剂按制法分为升丹和降丹。红升丹、白降丹、轻粉的主要成分分别为氧化汞（HgO）、氯化汞（HgCl₂）、氯化亚汞（Hg₂Cl₂）。